以下有关氧化锌粘固剂的论述中，不恰当的是
A. 比较软，有一定的安抚作用
B. 可作暂封材料
C. 对牙髓的刺激性极小
D. 树脂类材料充填可用氧化锌粘固剂作为垫底材料
E. 有镇痛的作用

正确答案：D。树脂类材料充填可用氧化锌粘固剂作为垫底材料

解析：由于粘固粉中的丁香油酚对聚合物有阻聚作用，甚至对已经聚合者，也可有某种程度的解聚作用。因此，与自凝塑料、树脂类材料、聚羧酸锌粘固粉和玻璃离子粘固粉均不能直接接触。掌握“口腔材料的性能与选择、垫底与暂封材料”知识点。